男，35岁。发现蛋白尿镜下血尿3年。血压升高1个月，BP160/100mmHg，尿RBC30～35HP。尿蛋白18g/d，血Cr130μmol/L，BUN8.2mmol/L，该患者首选的降压药物是
A. β受体阻滞剂
B. 利尿剂
C. 钙通道阻滞剂
D. α受体阻滞剂
E. 血管紧张素转换酶抑制剂

正确答案：E。血管紧张素转换酶抑制剂

解析：中年男性患者，发现蛋白尿、镜下血尿3年，伴血压升高，BUN8.2mmol/L（正常值为3.2～7.1mmol/L，提示血尿素氮升高），为肾功能不全的表现。综合患者的病史、临床表现，考虑诊断为肾功能不全合并高血压。该患者首选的降压药物是血管紧张素转换酶抑制剂（E对）。血管紧张素转换酶抑制剂（ACEI）通过抑制血管紧张素转换酶（ACE），减少血管紧张素Ⅱ的生成，同时抑制缓激肽酶使缓激肽降解减少，舒张外周血管起到降低血压的作用。另一方面，ACEI主要通过扩张出球小动脉的作用，减少残余肾单位的高滤过状态，减少蛋白尿的形成，为肾功能不全合并高血压的首选药。血肌酐超过3mg/dl（265μmol/L）患者使用时需谨慎（P255），本例患者血肌酐130μmol/L，可使用ACEI。β受体阻滞剂（P253）（A错）通过抑制中枢和周围RAAS（肾素-血管紧张素-醛固酮系统），抑制心肌收缩力和减慢心率发挥降压作用，主要用于心率较快的中、青年患者或合并心绞痛和慢性心力衰竭患者的降压治疗。利尿剂（P253）（B错）主要通过排钠，减少细胞外容量，降低外周血管阻力发挥降压作用，对单纯收缩期高血压、盐敏感性高血压、合并肥胖或糖尿病、更年期女性、合并心力衰竭和老年人高血压效果较好。钙通道阻滞剂（P254-P255）（C错）通过选择性阻滞钙通道，抑制细胞外Ca²⁺内流，减弱兴奋-收缩偶联，降低阻力血管的收缩反应和减轻血管紧张素Ⅱ和α₁肾上腺素能受体的缩血管效应发挥降压作用，主要用于合并稳定型心绞痛的老年高血压患者。α受体阻滞剂（九版药理学P87）（D错）通过扩张血管可以起到降压作用，但目前主要用于血管痉挛性疾病如闭塞性脉管炎、雷诺症等的治疗。